应激时应激性溃疡的发生与下列哪一项因素无关？
A. 粘膜缺血使能量供应不足及细胞再生能力降低
B. 糖皮质激素分泌增多引起胃粘膜屏障受损
C. 胃腔内H+向粘膜内反向弥散
D. 酸中毒时血流对粘膜内H+的缓冲能力降低
E. 胃粘膜合成前列腺素增多

正确答案：E。胃粘膜合成前列腺素增多

解析：粘膜缺血使能量供应不足及细胞再生能力降低（A对）、糖皮质激素分泌增多引起胃粘膜屏障受损（B对）、胃腔内H+向粘膜内反向弥散（C对）和酸中毒时血流对粘膜内H+的缓冲能力降低（D对）均与应激性溃疡有关，而与胃粘膜合成前列腺素增多（E错，为本题正确答案）无关。